长期使用可引起骨质疏松的药物是
A. 糖皮质激素
B. 胰岛素
C. 甲状腺素
D. 炔雌醇
E. 螺内酯

正确答案：A。糖皮质激素

解析：本题考查糖皮质激素的不良反应。长期使用可引起骨质疏松的药物是糖皮质激素（A对）。糖皮质激素长期大量应用可引起医源性肾上腺皮质功能亢进综合征，系过量用药导致肪代谢和水盐代谢紊乱的结果。表现为肌无力与肌萎缩、皮肤变薄、向心性肥胖、满月脸、水牛背、痤疮、多毛、水肿、高血压、高脂血症、低钾血症、糖尿、骨质疏松等，停药后一般可自行恢复正常。胰岛素（B错）常见不良反应有低血糖反应、过敏反应、胰岛素抵抗等。甲状腺素（C错）治疗开始时可能出现心动过速、心悸、心律不齐、心绞痛、头痛、肌肉无力和痉挛、潮红、发热、呕吐、月经紊乱、震颤、坐立不安、失眠、多汗、体重下降和腹泻。对部分超敏患者，可能会出现过敏反应。也可能会出现暂时性低血压、月经紊乱、体重减轻、骨骼肌痉挛、肌无力；偶见骨质疏松症。过量给药可出现甲状腺功能亢进症、甲状腺肿大，重复给药可引起抗体形成、促甲状腺素假性升高或对以后给予的促甲状腺素产生抗药性。炔雌醇（D错）属于雌激素，有促进骨质致密的作用。可用于治疗骨质疏松，调节骨代谢。螺内酯（E错）是低效利尿剂，久用易致高血钾，还可引起嗜睡、头痛、女性面部多毛、男性乳房女性化等。